腐肉已尽而脓水灰薄，新肉不生，状如镜面，光白板亮为
A. 走黄
B. 虚陷
C. 流注
D. 毒邪内攻
E. 流火

正确答案：B。虚陷

解析：火毒内陷，以皮损漫肿暗红或紫瘀，全身高热，口渴，烦躁，甚或斑疹隐隐，吐血衄血，舌质绛红，舌苔黄，脉数为常见症的流火证候（B对）。如疮顶突然陷黑无脓，四周皮肤暗红，肿势扩散，多为疗疮走黄之象（A错）。发于深部的脓肿归入“流注”的范畴（C错）。毒邪内攻，以红肿迅速蔓延，两目肿甚，不能睁开，兼见壮热不退，神昏谵语，烦躁不安，恶心呕吐，头身疼痛，小便黄赤，大便秘结，舌质红绛，舌苔黄燥，脉洪数为常见症的抱头火丹证候（D错）。发于小腿足部者，称流火（E错）。